我国云南个旧地区锡矿山是开采上百年的老矿，解放后随机械化开采后产量逐年增长，20世纪60年代末、70年代初矿工中的肺癌发病率也在逐年增长，进入80年代后达到顶峰，经过采取多项措施，自90年代逐渐有所控制，目前每年仍有少数发生。在这些致癌的原因中，哪一种的可能性最大
A. 矿尘中的锡
B. 矿尘中的石英
C. 矿尘中的砷
D. 井下空气中的氢及其子体
E. 香烟烟雾

正确答案：C。矿尘中的砷

解析：本题考查选项中致癌因素最强的物质。在题中锡（A错）、石英（B错）、砷（C对）、井下空气中的氢及其子体（D错）中，砷是致癌作用最强的，容易引发肺癌、皮肤癌、膀胱癌等多种癌症。香烟烟雾（E错）容易诱发肺癌，但不是题中癌症患者最大的患病原因。